下列不属于卫生系统健康治理的框架与原则的是
A. 公开透明
B. 依法治理
C. 惩罚制
D. 公正和广泛性
E. 伦理学原则

正确答案：C。惩罚制

解析：本题考查卫生系统健康治理的框架与原则。卫生系统健康治理的框架与原则包括：①具有战略视野；②建立共识；③依法治理（B对）；④公开和透明（A对）；⑤反应性；⑥公正和广泛性（D对）；⑦效果和效率；⑧问责制；⑨情报信息；⑩伦理学原则（E对）。惩罚制（C错，为本题正确答案）不属于卫生系统健康治理的框架与原则。